通草的适应证是
A. 产后乳汁不多
B. 风寒湿痹证
C. 湿阻中焦证
D. 寒湿泄泻证
E. 湿痰咳嗽证

正确答案：A。产后乳汁不多

解析：本题考查的是通草的主治病证。通草的适应证是产后乳汁不多（A对）。通草：【主治病证】（1）湿热淋证。（2）湿温证，水肿尿少。（3）产后乳汁不下。苍术：【主治病证】（1）湿阻中焦证（C错），痰饮，水肿。（2）风寒湿痹（B错），表证夹湿。（3）湿盛脚气、痿证。（4）夜盲，眼目昏涩。吴茱萸：【主治病证】（1）中寒肝逆之头痛、吐涎沫。（2）寒湿脚气肿痛，或上冲入腹之腹胀、困闷欲死。（3）寒疝腹痛，经寒痛经。（4）呕吐吞酸。（5）虚寒腹痛泄泻（D错）。橘红：【主治病证】（1）湿痰咳嗽（E错），痰多胸闷。（2）风寒咳嗽。（3）湿阻中焦。